关于快速进展性牙周炎，哪项正确
A. 发病年龄青春期至25岁之间
B. 病损好发于第一恒磨牙和上下前牙
C. 有严重及快速的骨破坏，然后破坏过程自然停止或显著减慢
D. 所有患者都有中性粒细胞及单核细胞的功能缺陷
E. 本病极少伴有全身症状

正确答案：C。有严重及快速的骨破坏，然后破坏过程自然停止或显著减慢

解析：本题考查广泛性侵袭性牙周炎。关于快速进展性牙周炎正确的是有严重及快速的骨破坏，然后破坏过程自然停止或显著减慢（C对）。快速进展性牙周炎主要发生在青春期至35岁之间（A错），病变广泛，可累及除切牙和第一磨牙以外的恒牙至少三颗（B错），有严重及快速的骨破坏，然后破坏过程自然停止或显著减慢，某些病例有阵发的静止期。快速进展性牙周炎多数患者有中性粒细胞及单核细胞的功能缺陷（D错），可伴有精神抑郁、体重减轻、全身不适等全身症状（E错）。